催化黄嘌呤脱氢酶转化为黄嘌呤氧化酶的是
A. 镁依赖蛋白酶
B. 锌依赖蛋白酶
C. 铁依赖蛋白酶
D. 钙依赖蛋白酶
E. 铜依赖蛋白酶

正确答案：D。钙依赖蛋白酶

解析：缺血时，由于ATP 减少，钙泵功能障碍，Ca2+进入细胞激活钙依赖蛋白酶（D对）使XD（黄嘌呤脱氢酶）大量转变为XO（黄嘌呤氧化酶）。